青霉素G最适于治疗
A. 伤寒、副伤寒
B. 肺炎杆菌性肺炎
C. 布氏杆菌病
D. 溶血性链球菌感染
E. 细菌性痢疾

正确答案：D。溶血性链球菌感染